2～6岁儿童平均身长（cm）推算公式是
A. 身高（cm）=年龄×7+75
B. 身高（cm）=年龄×5+70
C. 身高（cm）=年龄×6+80
D. 身高（cm）=年龄×7+80
E. 身高（cm）=年龄×9+80

正确答案：A。身高（cm）=年龄×7+75

解析：为了便于临床应用，可按以下公式粗略推算儿童平均身高：2～6岁：身高（cm）=年龄×7+75；7~10岁：身高（cm）=年龄（岁）×6+80。12岁以后为青春发育阶段，受内分泌影响，身高增长较快（是体格增长的第二个高峰），且存在较大的个体差异，不再按上述公式计算。掌握“体格生长常用指标”知识点。